目前国内最常用的包合材料是
A. 明胶
B. 聚酰胺
C. 脂质类
D. 聚维酮
E. β-CD

正确答案：E。β-CD